尿液呈浓茶色，镜检无红细胞，隐血试验阳性考虑的疾病是
A. 膀胱炎
B. 蚕豆病
C. 急性肾小球肾炎
D. 丝虫病
E. 血小板减少性紫癜

正确答案：B。蚕豆病

解析：当血管内大量红细胞被破坏时，出现血红蛋白尿，其颜色呈浓茶色或酱油色，镜检无红细胞，但隐血试验可呈强阳性。见于蚕豆病、阵发性睡眠性血红蛋白尿、血型不合的输血反应及恶性疟疾等（B对）。膀胱炎尿常规检查通常有小量的白细胞计数、血细胞、血尿比较严重时血细胞较多（A错）。急性肾小球肾炎镜检显示红细胞明显增多，尿沉渣检查红细胞达10个满视野/高倍镜。也可见颗粒管型、红细胞管型、肾小管上皮细胞及白细胞；尿蛋白阳性（C错）。丝虫病多见乳糜尿（D错）。血小板减少性紫癜多隐血试验阳性（E错）。